下列关于个人自用少量药品的进出境管理，说法正确的是
A. 出境时，麻醉药品和精神药品注射剂处方为1日用量，其他剂型一般不超过3日用量
B. 出境时，携带药品除医师专门注明理由外不得超过7日用量
C. 出国归来时，为邻居代购少量境外已合法上市的药品入境
D. 出入境时，携带超过自用合理数量的药品渠道向有关部门进行报关处置

正确答案：B、D。出境时，携带药品除医师专门注明理由外不得超过7日用量；出入境时，携带超过自用合理数量的药品渠道向有关部门进行报关处置

解析：本题考查个人自用少量药品的进出境管理。符合国家有关规定的有出境时，携带药品除医师专门注明理由外不得超过7日用量（B对）；出入境时，携带超过自用合理数量的药品渠道向有关部门进行报关处置（D对）。个人自用少量药品的进出境管理：进出境人员随身携带的个人自用的少量药品，应当以自用、合理数量为限，并接受海关监管（C错）。进出境人员随身携带第一类中的药品类易制毒化学品药品制剂和高锰酸钾，应当以自用且数量合理为限，并接受海关监管；进出境人员不得随身携带前款规定以外的易制毒化学品。在个人药品进出境过程中，应尽量携带好正规医疗机构出具的医疗诊断书，以证明其确因身体需要携带，方便海关凭医师有效处方原件确定携带药品的合理数量。除医师专门注明理由外，处方一般不得超过7日用量；麻醉药品与第一类精神药品注射剂处方为1次用量，其他剂型一般不超过3日用量（A错）。超过自用合理数量范围的药品应通过货物渠道进行报关处置。